男性，20岁。上前牙咀嚼时出现不适感1个月余。曾有过外伤史。半年前牙体变色。口腔检查：左右上1牙体变色，无明显龋损及其他牙体硬组织病变。牙髓活力测试无反应。叩诊（+）。X线片示：根尖部有圆形的透射影像，边界清晰，直径＜0.5cm，可能的诊断是
A. 根尖周囊肿
B. 根尖周肉芽肿
C. 慢性根尖周脓肿
D. 根尖周致密性骨炎
E. 牙髓坏死

正确答案：B。根尖周肉芽肿

解析：本题考查慢性根尖周炎。男性，20岁。上前牙咀嚼时出现不适感1个月余。曾有过外伤史。半年前牙体变色。口腔检查：左右上1牙体变色，无明显龋损及其他牙体硬组织病变。牙髓活力测试无反应。叩诊（+）。X线片示：根尖部有圆形的透射影像，边界清晰，直径＜0.5cm，可能的诊断是根尖周肉芽肿（B对）。慢性根尖周炎病变类型可有根尖周肉芽肿、慢性根尖周脓肿、根尖周囊肿和根尖周致密性骨炎。慢性根尖周炎一般无明显的自觉症状，有的患牙可在咀嚼时有不适感；检查发现患牙牙冠变色，失去光泽；深洞内探诊无反应，牙髓活力测验无反应；患牙对叩诊的反应无明显异常或仅有不适感；若X线检查发现根尖部透射影圆形，范围较小，直径小于1cm，边界清晰，周围骨质正常或稍显致密，多考虑为根尖周肉芽肿。较小的根尖周囊肿在根尖片上显示的透射影像与根尖周肉芽肿难以区别，大的根尖周囊肿（A错）可见有较大的圆形透射影区，边界清楚，并有一圈由致密骨组成的阻射白线围绕。慢性根尖周脓肿（C错）的根尖区透射影边界不清楚，形状也不规则，周围骨质疏松呈云雾状。根尖周致密性骨炎（D错）表现为根尖部骨质呈局限性的致密阻射影像，无透射区。牙髓坏死（E错）的患牙一般没有自觉症状，X线片上显示患牙根尖周影像无明显异常。